常山与雄黄的共同功效是
A. 杀虫
B. 截疟
C. 燥湿祛痰
D. 涌吐痰涎
E. 补火助阳

正确答案：B。截疟

解析：本题考查的是常山与雄黄的功效。常山与雄黄的共同功效是截疟（B对）。常山：【功效】涌吐痰饮（D错），截疟。雄黄：【功效】解毒，杀虫（A错），燥湿祛痰（C错），截疟定惊。硫黄：【功效】外用解毒杀虫止痒，内服补火助阳（E错）通便。